某男，35岁，体胖。长夏酷暑突患热病，症见身热肢酸、胸闷腹胀、尿赤黄疸，舌红苔黄腻。治当芳香化湿、清热解毒，宜选用的中成药是
A. 紫金锭
B. 六一散
C. 保济丸
D. 甘露消毒丸
E. 六合定中丸

正确答案：D。甘露消毒丸

解析：本题考查的是甘露消毒丸的功能。治当芳香化湿、清热解毒，宜选用的中成药是甘露消毒丸（D对）。甘露消毒丸：【功能】芳香化湿，清热解毒。紫金锭（A错）：【功能】辟瘟解毒，消肿止痛。六一散（B错）：【功能】清暑利湿。保济丸（C错）：【功能】解表，祛湿，和中。六合定中丸（E错）：【功能】祛暑除湿，和中消食。